可接受危险度是指
A. 当接触某种化学物质人群发生某种损害的频率低于非接触人群，那么，这一频率可作为该化学毒物对人体健康产生危害的可接受危险度
B. 当接触某种化学物质人群发生某种损害的频率接近或略高于非接触人群，那么，这一频率可作为该化学毒物对人体健康产生危害的可接受危险度
C. 当接触某种化学物质人群发生某种损害的频率高于非接触人群，那么，这一频率可作为该化学毒物对人体健康产生危害的可接受危险度
D. 只有当接触某种化学物质人群发生某种损害的频率与非接触人群一致，那么，这一频率可作为该化学毒物对人体健康产生危害的可接受危险度
E. 以上都不是

正确答案：B。当接触某种化学物质人群发生某种损害的频率接近或略高于非接触人群，那么，这一频率可作为该化学毒物对人体健康产生危害的可接受危险度